一项对控制吸烟的干预研究中，对观看录像的参与人数的评估是属于
A. 形成评价
B. 过程评价
C. 近期效果评价
D. 远期效果评价
E. 总结评价

正确答案：B。过程评价